以下哪一项是外斜线上附着的肌肉
A. 提上唇肌
B. 降上唇肌
C. 降口角肌
D. 提口角肌
E. 提上唇鼻翼肌

正确答案：C。降口角肌

解析：本题考查下颌骨及腭骨解剖特点。下颌体从颏结节向后上延至下颌支前缘的骨嵴，称为外斜线，有降下唇肌及降口角肌（C对）附着。